脂肪变性最常见的器官是
A. 肝
B. 肾
C. 脾
D. 肺
E. 脑

正确答案：A。肝

解析：脂肪变性多发生于肝、心、肾等实质器官，由于肝是脂肪代谢的重要场所，因此脂肪变性最常发生于肝（A对）。